关于口腔黏膜给药特点的说法，错误的是
A. 无全身治疗作用
B. 起效快
C. 给药方便
D. 适用于急症治疗
E. 可避开肝脏首关效应

正确答案：A。无全身治疗作用

解析：本题考查口腔黏膜给药特点。口腔黏膜给药制剂系指通过口腔黏膜吸收发挥局部或全身治疗作用（A错，为本题正确答案）的制剂；口腔黏膜吸收能避开肝脏的首关效应（E对）；起效快（B对），适用于急诊的治疗（D对）；给药方便（C对）。